男，45岁。突起寒战、发热伴右上腹胀痛2天。查体：T40℃，P100次/分，BP130/80mmHg。皮肤未见皮疹，浅表淋巴结无肿大，双肺呼吸音粗，未闻及干湿性啰音，心率100次/分，律齐，心音有力。右上腹压痛伴肌紧张，无反跳痛，肝肋下3cm。腹部X线：右膈肌抬高，运动受限。腹部B超：肝右叶占位性病变。最可能的诊断是
A. 急性肝炎
B. 急性胆管炎
C. 细菌性肝脓肿
D. 阿米巴肝脓肿
E. 肝癌破裂

正确答案：C。细菌性肝脓肿

解析：患者突发寒战、高热，右上腹胀痛、压痛伴肌紧张，肝大（细菌性肝脓肿的典型症状）。腹部X线：右膈肌抬高，运动受限。肝右叶占位性病变。最可能的诊断是细菌性肝脓肿（C对）。阿米巴肝脓肿（D错）起病较缓慢，病程较长，可有高热，或不规则发热、盗汗，黄疸少见。急性胆管炎（B错）表现为Charcot三联征：腹痛、黄疸、高热。肝癌破裂多表现为突然低血压休克，移动性浊音阳性（E错）